身无病，每三月一行经者，称为
A. 居经
B. 暗经
C. 闭经
D. 激经
E. 并月

正确答案：A。居经

解析：个别妇女身体无特殊不适而定期两个月来潮一次者，古人称为并月（E错）。三个月一潮者称为居经（A对），亦名季经。一年一行者称为避年。终身不潮者而能受孕者称为暗经（B错）。女子年逾16周岁，月经尚未来潮，或月经周期已建立又中断6个月或月经停闭超过了3个月经周期者，称为闭经（C错）。妊娠早期仍按月有少量阴道流血，但无损于胎儿者，称为激经（D错），亦称盛胎或垢胎。